属于外周性镇咳药的是
A. 右美沙芬
B. 特布他林
C. 福尔可定
D. 可待因
E. 苯丙哌林

正确答案：E。苯丙哌林

解析：本题考查镇咳药的分类。苯丙哌林（E对）属于外周性镇咳药。镇咳药可抑制咳嗽反射弧中的任何一个环节，具有镇咳作用。按其作用机制不同分为两大类：（1）外周性镇咳药：凡能通过抑制咳嗽反射弧中感受器、传入神经、传出神经中任何一个环节而发挥镇咳作用者，都归入此类，药品除苯丙哌林外还有普诺地嗪、甘草合剂、咳嗽糖浆。（2）中枢性镇咳药：即选择性地抑制延髓咳嗽中枢而发挥镇咳作用的药物，包括右美沙芬（A错）、喷托维林、地美索酯、二氧丙嗪、替培啶、福米诺苯、普罗吗酯、福尔可定（C错）和可待因（D错）。特布他林（B错）为常用的平喘药。